对烤瓷合金的要求不正确的是
A. 弹性模量小
B. 润湿性好
C. 收缩变形小
D. 铸造性能好
E. 不易变形和磨损

正确答案：A。弹性模量小

解析：本题考查烤瓷合金的要求。烤瓷合金应具有较高的弹性模量（A错，为本题的正确答案）和湿润性好（B对）以及收缩变形小（C对），这样有助于合金与瓷粉的牢固结合。此外，烤瓷合金还应具有铸造性能好（D对）的特点，这样不仅有助于合金与瓷粉的结合，还可使烤瓷牙的制作工艺简单化，减少成本。另外，烤瓷合金应不易变形和磨损（E对），这样有利于其在口腔中存在较长时间，有利于咀嚼功能的恢复。